患者，男性，18岁，先天性完全性腭裂4岁时行腭裂修复术，现腭前部牙槽突仍有裂隙与鼻腔相通，下前牙反牙合，上颌牙拥挤，面中部凹陷，面下部前突。腭裂修复术后，因咽腔过宽需行缩小咽腔手术，下列哪项属于缩小咽腔的手术术式
A. 三瓣法
B. 四瓣法
C. 兰氏法
D. 改良兰氏法
E. 腭咽肌瓣成形术

正确答案：E。腭咽肌瓣成形术

解析：本题考查腭裂的手术方法。腭咽肌瓣成形术（E对）属于缩小咽腔的手术术式。腭裂的手术方法大致可分为两大类：一类手术方法是封闭裂隙、保持和延伸软腭长度、恢复软腭生理功能为主的腭成形术；另一类手术是缩小咽腔、增进腭咽闭合为主的咽成形术。在年龄大的患儿或成年患者，如有必要可两类手术同时进行。三瓣法（A错）、四瓣法（B错）、兰氏法（C错）、改良兰氏法（D错）属于腭成形术。